女，64岁。持续胸痛4小时，突然出现头晕。查体BP95/65mmHg，心率32次/分，心律齐。心电图Ⅱ、Ⅲ、aVF导联ST段弓背向上抬高0.3mV，V₁～V₅导联ST段压低0.2mV，QRS波群时限0.14秒。该患者最可能出现的心律失常是
A. 二度窦房传导阻滞
B. 完全性右束支传导阻滞
C. 三度房室传导阻滞
D. 心房扑动
E. 窦性心动过缓

正确答案：C。三度房室传导阻滞

解析：患者老年女性，持续胸痛，突然出现头晕，心电图Ⅱ、Ⅲ、aVF导联ST段弓背向上抬高0.3mV，诊断为急性下壁ST段抬高性心肌梗死，V₁～V₅导联ST段压低0.2mV，提示伴有广泛前壁心肌缺血。急性下壁心肌梗死最常见的心律失常类型是三度房室传导阻滞，该患者心率32次/分，接近心室肌细胞自主频率，提示有房室分离，三度房室传导阻滞可引起房室分离，因此该患者最可能出现的心律失常是三度房室传导阻滞（C对）。二度窦房传导阻滞（P183）（A错）分为两型：莫氏Ⅰ型和Ⅱ型。Ⅰ型阻滞表现为传导时间进行性延长，直至一次冲动不能传导；Ⅱ型阻滞表现为间歇出现的传导阻滞。完全性右束支传导阻滞（P204）（B错）心电图可见QRS时限多大于0.12s，V₁或V₅导联QRS呈rsR’型或M型。完全性右束支传导阻滞本身不产生明显的血流动力学异常，故临床上也常无症状。心房扑动（P187）（D错）心电图特征为心房活动呈现规律的锯齿状扑动波称为F波，扑动波之间的等电线消失。窦性心动过缓（P182）（E错）指窦性心律的频率低于60次/分，可见于健康的青年人、运动员等，通常无明显症状。